以下颌前磨牙区和磨牙区多见的牙瘤为
A. 成釉细胞瘤
B. 牙源性钙化上皮瘤
C. 混合性牙瘤
D. 牙源性角化囊性瘤
E. 组合性牙瘤

正确答案：C。混合性牙瘤

解析：混合性牙瘤：多发生于儿童和青年，上下颌骨均可发生，以下颌前磨牙区和磨牙区多见。活动性生长期可引起颌骨膨大。掌握“牙瘤”知识点。